下列食物中，铁的良好来源是
A. 动物肝脏
B. 鱼
C. 蛋黄
D. 大豆
E. 小麦

正确答案：A。动物肝脏

解析：铁的良好来源是动物肝脏（A对）。